女性，29岁，口服长效激素类避孕药采取了避孕措施，以下哪项不属于激素避孕药物的不良反应
A. 类早孕反应
B. 阴道规律性出血
C. 闭经
D. 水钠潴留
E. 皮肤色素沉着

正确答案：B。阴道规律性出血

解析：激素类避孕药物的不良反应包括：类早孕反应，例如恶心，呕吐，乏力等；阴道不规则性出血；闭经，常发生于月经不规则妇女；水钠潴留导致体重增加；皮肤面部出现色素沉着、乳房胀痛、头痛、乳房胀痛等。掌握“激素避孕”知识点。